氨基糖甙类药物的抗菌机制是
A. 抑制细菌蛋白质合成
B. 抑制细菌细胞壁合成
C. 影响细菌细胞膜通透性
D. 干扰细菌叶酸代谢
E. 抑制细菌DNA螺旋酶

正确答案：A。抑制细菌蛋白质合成

解析：氨基糖苷类抗生素如链霉素、庆大霉素的抗菌机制主要是抑制细菌蛋白质合成（A对），还能破坏细菌胞质膜的完整性。抑制细菌细胞壁合成（B错）（P366）主要是β-内酰胺类抗生素（青霉素类、头孢菌素类等）抗菌的作用机制。影响细菌细胞膜通透性（C错）主要是多肽类抗生素和抗真菌药。干扰细菌叶酸代谢（D错）（	P400）是磺胺类药物抗菌的作用机制。抑制DNA回旋酶（DNA螺旋酶）（E错）（P395）主要是喹诺酮类药物抗菌的作用机制。